女，30岁。误服有机磷杀虫药600mL后出现恶心，呕吐，流涕，全身湿冷，双侧瞳孔呈针尖样1小时来诊。已经初步洗胃，胆碱酯酶复能药、阿托品治疗后症状缓解，但继之出现躁动，因而停用静脉阿托品，16小时后患者上述症状再次出现，呼吸心跳停止，心肺复苏抢救成功。患者心跳骤停的原因最可能是
A. 中毒性心肌炎
B. 中间型综合征
C. 阿托品减量过快
D. 迟发性神经病变
E. 呼吸肌受累致呼吸、循环衰竭

正确答案：B。中间型综合征

解析：患者中年女性，误服有机磷杀虫药后出现恶心，呕吐，流涕，全身湿冷，双侧瞳孔呈针尖样1小时（有机磷中毒典型症状），应用胆碱酯酶复能药、阿托品治疗后症状缓解，但继之出现躁动（提示阿托品中毒），因而停用阿托品（中间型综合征诱因），16小时后患者上述症状再次出现，呼吸心跳停止（系ChE长期受抑制，影响神经肌肉接头处突触后功能，呼吸肌麻痹导致的通气障碍性呼吸困难或衰竭），因此患者心跳骤停的原因最可能是中间型综合征（B对）。迟发性神经病变（D错）多于急性重度和中度OPI（甲胺磷、敌敌畏、乐果和敌百虫等）中毒病人症状消失后2～3周出现。中毒性心肌炎（A错）见于误服百草枯农药或灭鼠药后。